为预防大剂量环磷酰胺引起的膀胱毒性，在充分水化利尿的同时还应给予的药物是
A. 美司钠
B. 二甲双胍
C. 氯化钾
D. 螺内酯
E. 碳酸氢钠

正确答案：A。美司钠

解析：本题考查美司钠。为预防大剂量环磷酰胺引起的膀胱毒性，在充分水化利尿的同时还应给予的药物是美司钠（A对）。抗代谢药甲氨蝶呤属弱酸性药，主要由肾小球滤过和肾小管分泌排泄，长期应用甲氨蝶呤会引起肾毒性。为预防肾毒性，化疗期间除了补充大量水和给予利尿剂外，同时给予尿路保护剂美司钠，并碱化尿液。二甲双胍（B错）为降糖药，用于单纯饮食控制不满意的Ⅱ型糖尿病病人。氯化钾（C错）用于治疗各种原因引起的低钾血症以及预防低钾血症。螺内酯（D错）为保钾利尿药，用于水肿性疾病、高血压、原发性醛固酮增多症、低钾血症的预防。碳酸氢钠（E错）为抗酸药，用于治疗代谢性酸中毒、碱化尿液等，也可治疗胃酸过多引起的症状。